以医院为基础的病例对照研究，最易出现的偏倚是
A. 信息偏倚
B. 选择偏倚
C. 失访偏倚
D. 混杂偏倚
E. 回忆偏倚

正确答案：B。选择偏倚